属于渗透性泻药的是
A. 甘油
B. 液状石蜡
C. 酚酞
D. 普芦卡必利
E. 乳果糖

正确答案：E。乳果糖

解析：本题考查泻药的分类。渗透性泻药包括乳果糖（E对）、聚乙二醇、硫酸镁等；润滑性泻药包括甘油（A错）、液状石蜡（B错）、多库酯钠等；刺激性泻药包括酚酞（C错）、比沙可啶、蒽醌类药物（如大黄、番泻叶及麻仁丸等中药）和蓖麻油等；促动力药包括伊托必利、普芦卡必利（D错）、莫沙必利等。